一般用（）作为衡量高温作业劳动者劳动强度和受热程度的综合指标
A. 中心温度
B. 出汗量
C. 心率
D. 呼吸频率和通气量

正确答案：B。出汗量

解析：本题考查劳动者劳动强度和受热程度的指标。环境温度愈高，劳动强度愈大，人体出汗则愈多。汗液的有效蒸发率在干热有风的环境中高达80%以上，散热良好。但在湿热风小的环境，有效蒸发率则经常不足50%，不利于散热。出汗量（B对ACD错）是高温劳动者受热程度和劳动强度的综合指标。